患者女性，31岁，甲状腺弥漫性肿大，可触及震颤，伴有杂音，核素扫描为热结节，吸碘率增高，可诊断为
A. 甲状腺瘤
B. 甲状腺肿
C. 甲亢
D. 甲状腺癌
E. 结节性甲状腺肿

正确答案：C。甲亢

解析：本题患者女性，31岁，甲状腺弥漫性肿大，可触及震颤，伴有杂音，核素扫描为热结节，吸碘率增高，可诊断为甲亢（C对）。甲状腺腺瘤是最常见的甲状腺良性肿瘤。本病多发生于40岁以下的妇女，临床特点是颈前无痛性肿块，多为单发，质地柔韧，光滑，边界清楚，随吞咽动作上下移动，生长缓慢（A错）。甲状腺肿大 病程早期，甲状腺呈对称、弥漫性肿大，腺体表面光滑，质地柔软，随吞咽上下移动。后期在肿大腺体的一侧或两侧可扪及单个或多个结节，病程较长，发展缓慢。当囊肿样结节并发囊内出血时，可引起结节迅速增大，可伴有疼痛（B错）。甲状腺癌是最常见的甲状腺恶性肿瘤，临床特点是颈前正中或两侧出现质硬、表面高低不平肿块，不随吞咽动作而上下移动（D错）。结节性甲状腺肿早期无明显症状，甲状腺结节状肿大，并且甲状腺功能正常。后期因为甲状腺结节的异质性，临床症状也不一致，取决于结节性甲状腺肿的生长速度和有无甲状腺功能障碍。可有颈部疼痛及肿胀或压迫症状，伴有甲亢症状（E错）。